利巴韦林
A. 具有喹啉羧酸结构的药物
B. 具有咪唑结构的药物
C. 具有双三氮唑结构的药物
D. 具有单三氮唑结构的药物
E. 具有鸟嘌呤结构的药物

正确答案：D。具有单三氮唑结构的药物